Ⅱ°松动牙是指
A. 出现垂直向松动
B. 略大于生理动度在1mm以内
C. 从正常位置向任何方向摇动，动度大于2mm
D. 从正常位置向任何方向摇动，动度在1～2mm
E. 从正常位置向任何方向摇动，动度大于3mm

正确答案：D。从正常位置向任何方向摇动，动度在1～2mm

解析：本题考查牙松动度检查。Ⅱ°松动牙是指从正常位置向任何方向摇动，动度在1～2mm（D对）。牙周炎按松动度大小可分为Ⅰ度松动、Ⅱ度松动、Ⅲ度松动。Ⅰ度松动：松动超过生理动度，但幅度在1mm以内（B错）。Ⅱ度松动：松动幅度在1～2mm。Ⅲ度松动：松动幅度在2mm以上（CE错）。也可根据松动方向确定松动度，颊（唇）舌方向松动者为Ⅰ度，颊（唇）舌和近远中方向均松动者为Ⅱ度，颊（唇）舌、近远中和垂直方向均松动者（A错）为Ⅲ度。